分布于下肢血管的交感神经节后纤维发自
A. 腰、骶交感干神经节
B. 胸、腰交感干神经节
C. 腰交感干神经节
D. 骶交感干神经节
E. 尾交感干神经节

正确答案：A。腰、骶交感干神经节

解析：腰、骶交感干神经节（A对）发出节后纤维伴随血管分布至下肢。